“久卧伤气”的病因为
A. 六淫
B. 过逸
C. 七情
D. 痰饮、瘀血
E. 疠气

正确答案：B。过逸

解析：过度的安逸少动，阳气失于振奋，以致脏腑经络机能减退，表现为气虚（B对）。六淫（A错）的致病特点：外感性；季节性；地域性；相兼性。七情（C错）内伤的致病特点：直接损伤内脏；影响脏腑病机；多发为情志病。痰饮、瘀血（D错）、结石等是疾病过程中形成的病理产物。疠气（E错）的致病特点：①发病急骤，病情危笃。②传染性强，易于流行。③一气一病，症状相似。